女性，50岁，因呕吐、腹泻、低热于门诊应用庆大霉素32万U/日，共5天，近日来觉尿量有所减少约700～800ml/日，伴乏力、头晕，试验时检查尿蛋白（+），Hb100g/L，血清钾6.5mmol/L，BUN33.5mmol/L，血肌酐884mmol/L。该例最可能的诊断是
A. 庆大霉素导致急性肾衰竭
B. 庆大霉素过敏
C. 急性胃肠炎致肾损害
D. 腹泻脱水致急性肾功能损害
E. 急性间质性肾炎

正确答案：A。庆大霉素导致急性肾衰竭

解析：患者为中年女性，因呕吐、腹泻、低热应用服用庆大霉素5天后出现尿量减少，实验检查示蛋白尿，高钾（血清钾6.5mmol/L，正常值3.5～5.5mmol/L），BUN升高（BUN33.5 mmol/L，正常值3.5～7.1mmol/L），血肌酐升高（血肌酐884 mmol/L，尿毒症期或肾衰终末期：血清肌酐为大于707umol/L）（提示患者进入肾衰终末期）。综合患者的病史及实验室检查，考虑患者为服用庆大霉素导致急性肾衰竭（A对）。庆大霉素过敏（B错）一般表现为接触后立马出现皮疹，严重者表现为过敏性休克，与患者不符。急性胃肠炎致肾损害（C错）、腹泻脱水致急性肾功能损害（D错）一般发生于急性胃肠炎导致严重脱水，长时间未处理而导致的肾前性肾衰竭，应有有效循环血量不足及少尿等表现。急性间质性肾炎（E错）可出现在应用抗生素后，可出现肾小球及肾小管损伤而导致蛋白尿及尿量增多或肾性糖尿，多不会出现肾衰竭表现，该患者的实验室检查已然提示肾衰竭，因此可排除该诊断。